医疗机构在药品购销中暗中收受回扣或者其他利益，依法对其给予罚款处罚的机关是下列哪个部门
A. 劳动保障行政部门
B. 药品监督管理部门
C. 工商行政管理部门
D. 卫生行政部门
E. 中医药管理部门

正确答案：C。工商行政管理部门

解析：药品的生产企业、经营企业、医疗机构在药品购销中暗中给予、收受回扣或者其他利益的，药品的生产企业、经营企业或者其代理人给予使用其药品的医疗机构的负责人、药品采购人员、医师等有关人员以财物或者其他利益的，由工商行政管理部门处一万元以上二十万元以下的罚款，有违法所得的，予以没收；情节严重的，由工商行政管理部门吊销药品生产企业、药品经营企业的营业执照，并通知药品监督管理部门，由药品监督管理部门吊销其《药品生产许可证》、《药品经营许可证》；构成犯罪的，依法追究刑事责任。掌握“药品管理及法律责任”知识点。